某印染厂男工，45岁，工龄约10年。某日下班后突感到头痛、头晕、口唇及指端发绀，送急诊室就诊。化验检查的主要项目应包括
A. 红细胞计数
B. 血红蛋白含量
C. 高铁血红蛋白含量
D. 血小板计数
E. 碳氧血红蛋白含量

正确答案：C。高铁血红蛋白含量

解析：本题考查苯胺中毒的血液系统改变。从事印染行业的工人，处于长期暴露于苯胺的状态。同时长期慢性接触苯胺可出现类神经症，如头晕、头痛等症状，并出现口唇、指端及耳垂等部位的化学性发绀症状，该工人的表现符合苯胺中毒的症状，为苯胺中毒。当苯胺中毒时，会出现相应的以高铁血红蛋白血症为主的临床表现，其实验室结果为高铁血红蛋白增高（C对ABDE错）、红细胞内赫恩滋小体、尿中对氨基酚增高等症状。